防止子宫脱垂的重要结构是
A. 骶子宫韧带
B. 子宫阔韧带
C. 子宫主韧带
D. 卵巢悬韧带
E. 子宫圆韧带

正确答案：C。子宫主韧带

解析：骶子宫韧带（A错）与子宫圆韧带（B错）维持子宫的前倾前屈位，子宫主韧带（C对）是防止子宫脱垂的重要结构，卵巢悬韧带（D错）是寻找卵巢血管的标志，子宫圆韧带（E错）主要功能是维持子宫前倾。